患者，女性，33岁，脓毒性休克，症见高热，咳嗽气急，咽痛咳血，舌红绛，苔黄，脉疾数。治疗应选用
A. 犀角地黄汤合银翘散加减
B. 大承气汤加减
C. 小承气汤合小陷胸汤加减
D. 救逆汤加减
E. 回阳救急汤加减

正确答案：A。犀角地黄汤合银翘散加减

解析：综合观察其脉证，应为脓毒性休克肺源欲绝证，治法为凉血解毒，清络育阴，选方应为犀角地黄汤合银翘散加减（A对）。